患儿男，7岁。发热1天，体温39℃，咽痛，今晨发现皮疹。查体：咽部充血，扁桃体Ⅱ度，可见脓性分泌物，草莓舌，皮肤弥漫性充血，可见密集红色细小丘疹，心肺（-），腹软，肝脾未及。外周血WBC19×10⁹/L，中性粒细胞89％，最可能的诊断是
A. 麻疹
B. 风疹
C. 结核感染
D. 猩红热
E. 川崎病

正确答案：D。猩红热